患者胸腔积液合并剧烈胸痛，最可能的诊断是
A. 胸膜间皮瘤
B. 右心衰竭合并胸水
C. 结核性胸膜炎
D. 肝硬化引起胸水
E. 肺炎合并反应性胸膜炎

正确答案：A。胸膜间皮瘤

解析：胸腔积液是常见的内科问题，肺、胸膜和肺外疾病均可引起。本例患者有胸腔积液并有剧烈胸痛，首先考虑为肿瘤增生侵犯神经而剧痛，并引起胸膜通透性增加导致积液，即胸膜间皮瘤（A对）。右心衰竭合并胸水（B错）多为双侧，积液量右侧多于左侧，且有体循环淤血症状。结核性胸膜炎（C错）多见于青壮年，胸痛（积液增多后胸痛反而减轻或消失，但出现气急），并常伴有干咳、潮热、盗汗、消瘦等结核中毒症状。肝硬化引起胸水（D错）多伴腹水，极少仅表现为胸水。肺炎合并反应性胸膜炎（E错），患者多有发热、咳嗽、咳痰、胸痛等症状，白细胞升高，中性粒细胞增加和核左移。